细胞色素P450酶系催化的基本反应是
A. 单加氧反应
B. 水解反应
C. 脱氢反应
D. 共氧化反应

正确答案：A。单加氧反应

解析：本题考查细胞色素P450酶系催化的基本反应。细胞色素P450酶系催化的基本反应是单加氧反应（A对BCD错）。